既清热解毒，又清肺止咳的中成药是
A. 参苏丸
B. 午时茶
C. 感特灵胶囊
D. 双黄连片
E. 建曲

正确答案：C。感特灵胶囊